后牙Ⅱ类洞制备时，鸠尾峡宽度为
A. 颊舌牙尖间距的1/4
B. 颊舌牙尖间距的1/4～1/3
C. 颊舌牙尖间距的1/3～1/2
D. 颊舌牙尖间距的1/2～2/3
E. 颊舌牙尖间距的2/3～3/4

正确答案：B。颊舌牙尖间距的1/4～1/3

解析：本题考查窝洞的固位形-鸠尾固位。鸠尾固位形的外形似斑鸠的尾部，由鸠尾峡和膨大的尾部组成，借助于峡部的扣锁作用防止充填体从与洞底呈水平方向的脱位，后牙鸠尾峡宽度为所在颊舌牙尖间距的1/4～1/3（B对），前牙为邻面洞舌方宽度的1/3～1/2。